女性，28岁。婚后3天突起畏寒高热，尿频伴尿急，侧腰痛，既往无类似发作。尿常规：蛋白阴性，红细胞（0~3）个/HP，白细胞﹢﹢/HP。患者再次发生尿频、尿急，出现严重并发症。下列哪项应除外
A. 肾盂积脓
B. 肾周围脓肿
C. 败血症
D. 肾功能衰竭
E. 肾结核

正确答案：E。肾结核